下列除哪项外，均可引起阻塞性黄疸
A. 疟疾
B. 胆管癌
C. 肝癌
D. 胆道蛔虫症
E. 总胆管结石

正确答案：A。疟疾

解析：阻塞性黄疸是由于肝外胆管或肝内胆管阻塞所致的黄疸。胆管癌（B对）、肝癌（C对）、胆道蛔虫症（D对）、总胆管结石（E对）均可引起肝外胆管或肝内胆管阻塞，从而引起阻塞性黄疸。疟疾（A错，为本题正确答案）可引起溶血性黄疸。